患者，女。62岁，医师处方如下：姓名：XXX，性别：女，年龄：62，临床诊断：2型糖尿病高血压2期高血脂PCI术后，R：二甲双胍片0.25g×48×3盒/0.5gtid，Po餐中，阿卡波糖片50mg×30×3盒/50mg，tid，po与第一口饭同服，氯吡格雷片75mg×7×4盒/750mg，tid，po清晨，氨氯地平片5mg×7×4盒/5mg，tid，po餐后，辛伐他汀片20mg×7×4盒/20mg，qd，po清晨，本处方中，给药次数错误的是
A. 二甲双胍
B. 阿卡波糖
C. 氯吡格雷
D. 氨氯地平
E. 辛伐他汀

正确答案：D。氨氯地平

解析：本题考查药物的使用。处方中，给药次数错误的是氨氯地平（D错，为本题正确答案）。氨氯地平属于长效降压药物，口服，起始剂量每次5mg，每日1次，以后根据需要可逐渐增至每日10mg。二甲双胍片（A对）和阿卡波糖（B对）一日3次，餐中口服。氯吡格雷（C对）每日3次服用。辛伐他汀（E对）每日1次给药，夜间服用。